下列哪一项不是经行情志异常的症状
A. 悲伤啼哭
B. 头晕耳鸣
C. 狂躁不安
D. 情志抑郁
E. 烦躁易怒

正确答案：B。头晕耳鸣

解析：头晕耳鸣是经行的异常情况，代表血虚或肾虚等（B错，为本题正确答案）。一般行经期会有轻度神经系统不稳定的症状如悲伤啼哭，狂躁不安，情志抑郁，烦躁易怒等（ACDE对）。